具有苯乙醇胺结构的β₁-受体拮抗剂是
A. 盐酸普萘洛尔
B. 盐酸索他洛尔
C. 酒石酸美托洛尔
D. 艾司洛尔
E. 马来酸噻吗洛尔

正确答案：B。盐酸索他洛尔

解析：本题考查β-受体拮抗剂的作用特点。盐酸索他洛尔（B对）含有苯乙醇胺类结构，具有阻断β受体和延长心肌动作电位的双重作用。